在患者入院、转科和出院时，药师通过核对新开的医嘱和已有的医瞩，核对患者目前的整体用药情况，避免漏用药物、重复用药、剂量错误和不良药物相互作用等，以保证患者用药安全的药学服务过程，属于
A. 药物重整
B. 处方审核
C. 药物利用研究和评价
D. 药学干预
E. 处方点评

正确答案：A。药物重整

解析：本题考查药学服务内容的基本概念。在患者入院、转科和出院时，药师通过核对新开的医嘱和已有的医瞩，核对患者目前的整体用药情况，避免漏用药物、重复用药、剂量错误和不良药物相互作用等，以保证患者用药安全的药学服务过程，属于药物重整（A对）。处方审核（B错）是指药师在调剂工作中，首先要审核处方的合法性，然后对处方的规范和完整性（前记、正文、后记）、处方的病情诊断与用药的适宜性、用药的合理性（给药途径、剂量、疗程、报销范围）进行审核。药物利用研究和评价（C错）是对全社会的药品市场、供给、处方及临床使用进行研究，重点研究药物所引起的医药、社会和经济等各方面后果以及各种药物和非药物因素对药物利用的影响，其目的是保证用药的合理化。药学干预（D错）是对医师处方的规范性和适宜性进行监测。处方点评（E错）是根据原卫生部《处方管理办法》、《医院处方点评管理规范（试行）》和世界卫生组织门诊处方评价指标等相关法规、技术规范，对处方书写的规范性（格式、完整性）及药物临床使用的适宜性进行评价，发现存在或潜在的问题，制定并实施干预和改进措施，促进临床药物合理应用的过程。